鳞状细胞癌好发于
A. 新生儿
B. 青少年的烟酒嗜好者
C. 40～60岁的烟酒嗜好者
D. 烫食嗜好者
E. 老年人

正确答案：C。40～60岁的烟酒嗜好者

解析：鳞状细胞癌是具有不同程度鳞状分化的上皮性侵袭性的肿瘤，有早期、广泛淋巴结转移的倾向，且主要发生在40～60岁的烟酒嗜好者。掌握“口腔黏膜鳞癌及疣状癌”知识点。